痄腮睾丸肿痛，是由于风温邪毒壅结于
A. 足阳明胃经
B. 足厥阴肝经
C. 足少阳胆经
D. 足太阳膀胱经
E. 手少阳三焦经

正确答案：B。足厥阴肝经

解析：少阳与厥阴互为表里，病则相互传变。若受邪较重，则由少阳而及厥阴。足厥阴之脉循少腹而络阴器，故痄腮睾丸肿痛，是由于风温邪毒壅结于足少阳经，又传于足厥阴肝经所致（B对）。（ACDE错）。